根据《药品广告审查办法》，药品生产企业在企业所在地拟发布药品广告的要求是
A. 在发布地省级药品监督管理部门备案
B. 无需经过药品广告审查机关审查
C. 由发布地省级药品监督管理部门审查
D. 由发布地工商行政管理部门备案
E. 在国家工商行政管理部门备案

正确答案：C。由发布地省级药品监督管理部门审查

解析：本题考查药品广告的审查部门。药品生产企业在企业所在地拟发布药品广告的要求是由发布地省级药品监督管理部门审查（C对）。药品广告的审查部门：国家市场监督管理总局负责组织指导药品、医疗器械、保健食品和特殊医学用途配方食品广告审查工作。各省（区、市）市场监督管理部门、药品监督管理部门（以下称广告审查机关）负责药品、医疗器械、保健食品和特殊医学用途配方食品广告审查，依法可以委托其他行政机关具体实施广告审查。